预防急性肾功能衰竭可选用
A. 呋塞米
B. 乙酰唑胺
C. 氢氯噻嗪
D. 螺内酯
E. 氨苯蝶啶

正确答案：A。呋塞米

解析：本题考查利尿药的临床应用。预防急性肾功能衰竭可选用呋塞米（A对）。呋塞米的临床应用：1.消除各种严重水肿；2.治疗急性肺水肿和脑水肿；3.预防急性肾衰竭；4.加速中毒药物排泄。乙酰唑胺（B错）的临床应用：1.治疗青光眼；2.急性高山病；3.碱化尿液；4.纠正代谢性碱中毒；5.其他：可用作癫痫的辅助治疗；伴有低钾血症的周期性麻痹；严重高磷酸盐血症，增加磷酸盐的尿排泄。氢氯噻嗪（C错）的临床应用：1.水肿；2.高血压病；3.尿崩症。螺内酯（D错）的临床应用：1.与醛固酮升高有关的顽固性水肿；2.充血性心力衰竭；3.高血压；4.低钾血症的预防。氨苯蝶啶（E错）在临床上用于治疗各种水肿，常与排钾利尿药合用治疗顽固性水肿。